对于细菌内毒素作用的描述，错误的是
A. 发热
B. 白细胞升高
C. 微循环障碍
D. DIC
E. 对组织器官有选择性毒害效应

正确答案：E。对组织器官有选择性毒害效应

解析：内毒素是革兰阴性细菌细胞壁中的脂多糖组分，只有在细菌死亡裂解后才被释放出来，毒性作用相对较弱且对组织无选择性（E错，为本题正确答案）。内毒素引起的主要生理病理反应有：①致发热反应（A对）：内毒素可作用于巨噬细胞、血管内皮细胞等，产生IL-1、IL-6和TNF-α等细胞因子，这些细胞因子是内濒性致热原，可作用于宿主下丘脑体温调节中枢，导致发热反应；②引起白细胞数量升高（B对）：内毒素进入人体初期，可使中性粒细胞裂黏附到组织毛细血管壁，导致中性粒细胞数减少，数小时后，由LPS诱生的中性粒细胞释放因子刺激骨髓释放中性粒细胞进入血流，使数量显著增加；③导致内毒素血症，内毒素作用于巨噬细胞、内皮细胞、血小板、补体系统、凝血系统等，并诱生IL-1、IL-6、IL-8、TNF-α、组胺、5-羟色胺、前列腺素、激肽等生物活性物质，使小血管功能紊乱而造成微循环障碍（C对），组织器官毛细血管灌注不足、缺氧、酸中毒等；高浓度的内毒素能激活补体替代途径，引发高热、低血压，以及活化凝血系统，最后导致DIC（D对）。